慢性毒性试验结束时，将部分实验动物继续留养1～2个月，其目的不包括
A. 补充实验动物的数目的不足
B. 对已显变化的指标进行跟踪观察
C. 观察受试化学毒物有无后作用
D. 观察受试化学毒物有无迟发作用

正确答案：A。补充实验动物的数目的不足

解析：本题考查慢性毒性试验结束时，将部分实验动物继续留养的目的。慢性毒性试验结束时，将部分实验动物继续留养1～2个月，其目的是：对已显变化的指标进行跟踪观察（B对），观察受试化学毒物有无后作用（C对）和迟发作用（D对）。补充实验动物的数目的不足（A错，为本题正确答案）不是继续留养的目的。